某奶牛场有数十只乳牛患乳房炎，其所产牛奶应
A. 消毒废弃
B. 煮沸后喂饲牛犊
C. 经巴氏消毒后食用
D. 加工成奶粉
E. 加工成酸奶

正确答案：A。消毒废弃